引起移植物抗宿主反应是由于
A. 供体内预存有抗受体的ABO血型抗体
B. 供体内预存有抗受体的HLAI类抗原的抗体
C. 受体内预存有抗供体的ABO血型抗体
D. 受体内有针对供体组织器官的Tc细胞
E. 供受者HLA配型不符

正确答案：E。供受者HLA配型不符

解析：引起移植物抗宿主反应的主要原因是：供受者HLA配型不符（E对）、移植物物中含有足够数量的免疫细胞，尤其是成熟T细胞、移植受者处于免疫失能或免疫功能极度低下的状态。超急性排斥反应属于宿主抗移植物反应，是由于受者体内预先存在抗供者组织抗原的抗体，包括抗供者ABO血型抗原、血小板抗原、HLA抗原等（C错）。Tc细胞即细胞毒性T细胞，能特异性杀伤带抗原的靶细胞，如移植细胞、肿瘤细胞及受微生物感染的细胞等，受体内有针对供体组织器官的Tc细胞（D错），表现为宿主抗移植物反应。供体内预存有抗受体的ABO血型抗体（A错）、供体内预存有抗受体的HLA I类抗原的抗体（B错）不是引起移植物抗宿主反应的主要原因。